甘油异生成糖时最主要的中间产物是
A. 草酰乙酸
B. 磷酸二羟丙酮
C. 脂肪酸
D. 柠檬酸
E. 乙酰乙酸

正确答案：B。磷酸二羟丙酮

解析：甘油可转化成α-磷酸甘油，再脱氢生成磷酸二羟丙酮（B对）。糖异生中，草酰乙酸（A错）在磷酸烯醇式丙酮酸羧激酶作用下转变为磷酸烯醇式丙酮酸。脂肪酸（C错）不参与糖异生过程。柠檬酸（D错）主要作为生糖氨基酸异生成糖的中间产物。乙酰乙酸（E错）属于酮体，是脂肪酸在肝脏进行正常分解代谢所生成的特殊中间产物，不参与糖异生过程。